药学人员之间的道德准则包括
A. 认真负责
B. 紧密配合
C. 廉洁奉公
D. 精益求精
E. 热忱服务

正确答案：B。紧密配合

解析：本题考查执业药师职业道德准则。药学人员之间的道德准则包括紧密配合（B对）。执业药师的职业道德准则包括：1.救死扶伤，不辱使命；2.尊重患者，平等相待；3.依法执业，质量第一；4.进德修业，珍视声誉；5.尊重同仁，密切协作。执业药师应当与同仁和医护人员相互理解，相互信任，以诚相待，密切配合，建立和谐的工作关系，共同为药学事业的发展和人类的健康奉献力量。